肺心病心功能失代偿期多表现为
A. 以右心衰竭为主
B. 低氧血症
C. 二氧化碳潴留
D. 全心衰竭
E. 肺水肿

正确答案：A。以右心衰竭为主

解析：肺心病失代偿期主要表现为呼吸衰竭及右心衰竭（A对D错），呼吸衰竭主要表现为呼吸困难、发绀明显、减反射减弱或消失、出现病理反射、周围血管征；右心衰竭主要表现为颈静脉怒张、重者可有腹水。低氧血症（B错）、二氧化碳潴留（C错）、肺水肿（E错）为肺心病肺、心功能代偿期表现。